重症肌无力、癫痫禁用的
A. 米诺环素
B. 甲硝唑
C. 左氧氟沙星
D. 哌拉西林
E. 罗红霉素

正确答案：C。左氧氟沙星

解析：本题考查药物的不良反应。左氧氟沙星（C对）属于氟喹诺酮类药物，重症肌无力、癫痫患者禁用氟喹诺酮类药物。米诺环素（A错）为四环素类，可以导致前庭功能失调（眩晕）。甲硝唑（B错）不良反应为双硫仑样反应。哌拉西林（D错）为青霉素类药物，有过敏史禁用。罗红霉素（E错）为大环内酯类，与红霉素存在交叉耐药性。